主含生物碱的药材有
A. 马钱子
B. 连翘
C. 五味子
D. 槟榔
E. 薏苡仁

正确答案：A、D。马钱子；槟榔

解析：本题考查的是马钱子与槟榔的成分。主含生物碱的药材有马钱子（A对）、槟榔（D对）。马钱子【成分】马钱种子含总生物碱2%～5%，主要为番木鳖碱（士的宁），异番木鳖碱，马钱子碱，另含微量的番木鳖次碱、伪番木鳖碱、伪马钱子碱、异马钱子碱等。槟榔【成分】种子含多种与鞣质结合的生物碱，总生物碱含量0.3%～0.7%，槟榔碱含量最高，为其有效成分；其次为槟榔次碱、去甲基槟榔碱、去甲基槟榔次碱、异去甲基槟榔次碱、槟榔副碱及高槟榔碱等。连翘（B错）【成分】果皮含连翘酚、齐墩果酸、甾醇化合物、白桦脂醇酸、连翘苷、连翘苷元、松脂素、牛蒡子苷、牛蒡子苷元、黄酮醇苷及皂苷等。连翘酚为抗菌成分。五味子（C错）【成分】果实含挥发油0.89%。薏苡仁（E错）【成分】种仁含薏苡仁酯，薏苡素，薏苡多糖A、B、C，葡聚糖等。